牛黄解毒丸的赋形剂宜选用
A. 炼蜜
B. 米糊
C. 米醋加水
D. 药汁
E. 聚乙二醇6000

正确答案：A。炼蜜

解析：本题考查丸剂的分类。牛黄解毒丸的赋形剂宜选用炼蜜（A对）。牛黄解毒丸为蜜丸。丸剂按赋形剂分类：按赋形剂不同，丸剂可分为水丸、蜜丸、水蜜丸、浓缩丸、糊丸、蜡丸、糖丸等。蜜丸：系指饮片细粉以炼蜜为黏合剂制成的丸剂。糊丸：系指饮片细粉以米糊（B错）或面糊等为黏合剂制成的丸剂。水丸：系指饮片细粉以水（或根据制法用黄酒、醋（C错）、稀药汁（D错）、糖液、含5%以下炼蜜的水溶液等）为黏合剂制成的丸剂。习称水泛丸。滴丸基质有水溶性和非水溶性两大类：①水溶性基质，常用的有聚乙二醇类（如聚乙二醇6000（E错）、聚乙二醇4000等）、泊洛沙姆、硬脂酸聚烃氧（40）酯（商品名S-40）、明胶、甘油明胶、硬脂酸钠等。②非水溶性基质，常用的有硬脂酸、单硬脂酸甘油酯、氢化植物油、虫蜡、蜂蜡、十八醇等。根据需要，不同基质可配合使用，增加药物的溶解量，调节药物溶出或溶散时间，并有利于制备成型。